国家规定的疫苗记录不包括
A. 被接种人
B. 接种时间
C. 接种后注意事项
D. 疫苗的批次
E. 疫苗的种类

正确答案：C。接种后注意事项

解析：国家规定的疫苗记录包括被接种人（A对）、接种时间（B对）、疫苗的批次（D对）和疫苗的种类（E对）等内容，不包括接种后注意事项（C错，为本题正确答案）。